白芥子具有的功效是
A. 温肺
B. 降气
C. 利尿
D. 除湿
E. 渗湿

正确答案：A。温肺

解析：白芥子辛散温通，气锐走窜，专入肺经。既温肺脏、豁寒痰、利气机，又通经络、散寒结、止疼痛。善治寒痰及痰饮诸证，尤以痰在皮里膜外及经络者最宜（A对）。有降气（B错）功效的中药有旋覆花、白前、前胡等。有利尿（C错）功效的中药有浮萍、芦根、竹叶、车前子、滑石、木通等。有除湿（D错）功效的中药有羌活、蒿本、独活、川乌等。有渗湿（E错）功效的中药有茯苓、薏苡仁等。